濒临灭绝状态的稀有珍贵野生药材物种是
A. 黄芪
B. 黄柏
C. 黄芩
D. 半夏
E. 羚羊角

正确答案：E。羚羊角

解析：本题考查的是国家重点保护的野生药材分级及名录。濒临灭绝状态的稀有珍贵野生药材物种是羚羊角（E对）。国家重点保护野生药材物种的分级和管理：国家重点保护的野生药材物种分为三级管理。一级保护野生药材物种：系指濒临灭绝状态的稀有珍贵野生药材物种。二级保护野生药材物种：系指分布区域缩小，资源处于衰竭状态的重要野生药材物种。三级保护野生药材物种：系指资源严重减少的主要常用野生药材物种。国家重点保护的野生药材名录：（1）一级保护药材名称：虎骨、豹骨、羚羊角、鹿茸（梅花鹿）。（2）二级保护药材名称：鹿茸（马鹿）、麝香（3个品种）、熊胆（2个品种）、穿山甲、蟾酥（2个品种）、哈蟆油、金钱白花蛇、乌梢蛇、蕲蛇、蛤蚧、甘草（3个品种）、黄连（3个品种）、人参、杜仲、厚朴（2个品种）、黄柏（B错）（2个品种）、血竭。（3）三级保护药材名称：川贝母（4个品种）、伊贝母（2个品种）、刺五加、黄芩（C错）、天冬、猪苓、龙胆（4个品种）、防风、远志（2个品种）、胡黄连、肉苁蓉、秦艽（4个品种）、细辛（3个品种）、紫草、五味子（2个品种）、蔓荆子（2个品种）、诃子（2个品种）、山茱萸、石斛（5个品种）、阿魏（2个品种）、连翘（2个品种）、羌活（2个品种）。丁香、八角茴香、山药、山楂、乌梅、木瓜、龙眼肉（桂圆）、决明子、百合、阿胶、枣（大枣、酸枣、黑枣）、罗汉果、郁李仁、金银花、姜（生姜、干姜）、藿香、党参、铁皮石斛、西洋参、黄芪（A错）、灵芝、山茱萸、天麻、杜仲叶、当归等常见的中药材都被纳入按照传统既是食品又是中药材的物质目录管理。毒性药品中药品种共27种：砒石（红砒、白砒）、砒霜、水银、生马钱子、生川乌、生草乌、生白附子、生附子、生半夏（D错）、生南星、生巴豆、斑蝥、青娘虫、红娘子、生甘遂、生狼毒、生藤黄、生千金子、生天仙子、闹羊花、雪上一枝蒿、白降丹、蟾酥、洋金花、红粉、轻粉、雄黄。需要说明的是上述中药品种是指原药材和饮片，不含制剂。